固位形不包括
A. 侧壁固位
B. 倒凹固位
C. 鸠尾固位
D. 梯形固位
E. 粘接固位

正确答案：E。粘接固位

解析：本题考查窝洞的固位形。粘接固位为固位原理的一种，不属于固位形的范畴（E错，为本题的正确答案）。固位形是防止充填体在侧向或垂直方向力量作用下移位脱落的形状，包括：侧壁固位（A对）、倒凹固位（B对）、鸠尾固位（C对）、梯形固位（D对）。